药品不良反应监测的说法，错误的是
A. 药物不良反应监测是指对上市后的药品实施的监测
B. 药物不良反应监测包括药物警戒的所有内容
C. 药物不良反应监测主要针对质量合格的药品
D. 药物不良反应监测主要包括对药品不良信息的收集，分析和监测
E. 药物不良反应监测不包含药物滥用与误用的监测

正确答案：B。药物不良反应监测包括药物警戒的所有内容

解析：本题考查药品不良反应监测。药物警戒是与发现、评价、理解和预防不良反应或其他任何可能与药物有关问题的科学研究与活动。药物警戒不仅涉及药物的不良反应，还涉及与药物相关的其他问题，如不合格药品、药物治疗错误、缺乏有效性的报告、对没有充分科学根据而不被认可的适应证的用药、急慢性中毒的病例报告、与药物相关的病死率的评价、药物的滥用与错用、药物与化学药物、其他药物和食品的不良相互作用（B错，为本题正确答案）。